阿昔洛韦片治疗带状疱疹的用法用量是
A. 一次200mg，一日3次
B. 一次400mg，一日3次
C. 一次800mg，一日2次
D. 一次800mg，一日3次
E. 一次800mg，一日5次

正确答案：E。一次800mg，一日5次

解析：本题考查阿昔洛韦的使用。阿昔洛韦片治疗带状疱疹的用法用量是一次800mg，一日5次（E对CD错）。阿昔洛韦片口服治疗带状疱疹成人常用量1次0.8g，一日5次，共7-10天，肾功能不全需调整用量。生殖器疱疹初治和免疫缺陷者皮肤黏膜单纯疱疹，一次200mg，一日5次，连续10日为1疗程；或一次400mg，一日3次（B错），5日为1疗程。复发性感染，一次200mg，一日5次，连续5日为1疗程。复发性感染的慢性抑制疗法，一次200mg，一日3次（A错），连续6月为1疗程；必要时剂量可加至一日5次，连续6～12月为1疗程。